通常三环类抗抑郁药物的每天治疗剂量为
A. 50mg
B. 50～75mg
C. 75～100mg
D. 150～300mg
E. 300～400mg

正确答案：D。150～300mg

解析：三环类抗抑郁剂治疗指数低，剂量范围受镇静、抗胆碱能和心血管毒副作用限制，一般为150-300mg/日（D对），应从小剂量开始，逐渐加至治疗有效量。